与丙磺舒联合应用，有增效作用的药物是
A. 四环素
B. 氯霉素
C. 青霉素
D. 红霉素
E. 罗红霉素

正确答案：C。青霉素

解析：本题考查药物的相互作用。丙磺舒和青霉素（C对）均为酸性药，两者同用会经同种载体转运，发生竞争性抑制，青霉素的代谢变慢，作用时间延长，抗菌作用增强。